耐甲氧西林金黄色葡萄菌感染宜首选的抗菌药物是
A. 利奈唑胺
B. 头孢他啶
C. 头孢曲松
D. 罗红霉素
E. 头孢噻肟

正确答案：A。利奈唑胺

解析：本题考查利奈唑胺。利奈唑胺（A对）是耐甲氧西林金黄色葡萄菌感染的首选。利奈唑胺临床主要用于敏感菌所致的感染：（1）耐万古霉素的屎肠球菌引起的感染，包括并发的菌血症。（2）致病菌为金黄色葡萄球菌（甲氧西林敏感或耐甲氧西林的菌株）或肺炎链球菌（包括多重耐药菌株）引起的院内获得性肺炎。（3）金黄色葡萄球菌（甲氧西林敏感或耐甲氧西林的菌株）、化脓链球菌或无乳链菌引起的复杂性皮肤或皮肤软组织感染，包括未并发骨髓炎的糖尿病足部感染。（4）金黄色葡萄球菌（仅为甲氧西林敏感的菌株）或化脓链球菌引起的非复杂性皮肤或皮肤软组织感染。（5）由肺炎链球菌（包括对多药耐药的菌株）、由金黄色葡萄球菌（仅为甲氧西林敏感的菌株）所致的社区获得性肺炎及伴发的菌血症。头孢他啶（B错）是铜绿假单胞菌感染首选的抗菌药。头孢他啶属第三代头孢菌素，对革兰阳性菌虽有一定的抗菌毒性，但较第一、二代弱，对革兰氏阳性菌包括肠杆菌、铜绿假单胞菌及厌氧菌如脆弱拟杆菌均有较强的抗菌作用，对流感杆菌、淋球菌具有良好的抗菌毒性。头孢曲松（C错）也属第三代头孢菌素，但对铜绿假单胞菌作用不及头孢他啶。头孢噻肟（E错）为第三代半合成头孢菌素，抗菌谱比头孢呋肟更广，对革兰阴性菌的作用更强，但对阳性球菌不如第一代与第二代头孢菌素。对绿脓杆菌与厌氧菌仅有低度抗菌作用。抗菌谱包括嗜血性流感杆菌、大肠杆菌、沙门杆菌、克雷白产气杆菌属及奇异变形杆菌、奈瑟菌属、葡萄球菌、肺炎球菌、链球菌等。罗红霉素（D错）临床用于敏感菌株所致的感染：（1）上、下呼吸道感染；（2）耳鼻喉感染；（3）生殖器感染（淋球菌感染除外）；（4）皮肤软组织感染；（5）支气管肺炎、沙眼衣原体感染及军团病等。